随机分组的作用在于
A. 保证样本的代表性
B. 保证两组之间的可比性
C. 可避免来自病人和医生两方面的偏倚
D. 消除病人的主观选择研究条件对结果的影响
E. 检验两组的可比性

正确答案：B。保证两组之间的可比性

解析：本题考查随机分组的作用。随机分组即将研究对象随机分配到实验组和对照组，使每个研究对象都有同等的机会被分配到各组去，以平衡实验组和对照组各种已知和未知的混杂因素，从而提高两组的可比性（B对ACDE错），避免造成偏倚。